患者戴用全口义齿1周后，自诉义齿易松动。何时需要重衬
A. 义齿不稳定
B. 义齿两边翘动
C. 义齿咬合不平衡
D. 义齿边缘封闭差或不密贴
E. 上颌隆突缓冲不够

正确答案：D。义齿边缘封闭差或不密贴

解析：本题考查全口义齿固位不良的情况、原因及处理方法。全口义齿易松动即固位不良。而重衬是在全口义齿的组织面上加上一层树脂材料，使其充满牙槽嵴及周围组织的间隙，使基托组织面与周围的组织紧密贴合，增加义齿的固位力。当义齿边缘封闭差或不密贴（D对）时需要重衬，因为此时缘封闭作用不好，义齿易松动脱落。义齿不稳定（A错）常由于人工牙排列位置不正确或有早接触点造成，应重新排牙而不是重衬。义齿两边翘动（B错）常由于义齿上存在支点造成，应进行调磨而不是重衬。义齿咬合不平衡（C错）常由于牙尖早接触，压力过大造成，应进行调磨而不是重衬。上颌隆突缓冲不够（E错）应进行缓冲处理而不是重衬。